在评价小气候时，必须采用包括
A. 气温、气湿和气压三种因素的综合指标来评价
B. 气流、气压和热辐射三种因素的综合指标来评价
C. 气温、气湿、气流和热辐射四种因素的综合指标来评价
D. 气温、气湿、气压和热辐射四种因素的综合指标来评价
E. 气温、气流、气压和热辐射四种因素的综合指标来评价

正确答案：C。气温、气湿、气流和热辐射四种因素的综合指标来评价

解析：本题考查评价小气候的因素。室内小气候是指住宅的室内由于屋顶、地板、门窗和墙壁等围护结构以及室内的人工空气调节设备等综合作用，形成了与室外不同的室内气候。在评价小气候时，必须采用包括气温、气湿、气流和热辐射四种因素的综合指标来评价（C对ABDE错）。